男，45岁，急性胰腺炎，静脉应用广谱抗生素非手术治疗1周后，腹痛、腹胀加重，体温再度升高。此时应紧急选择最有诊断意义的检查是
A. 血白细胞计数+分类
B. 腹部平片了解有无肠麻痹
C. CT检查注意是否发生胰腺坏死
D. 腹腔穿刺检测渗出液淀粉酶含量
E. 检查血脂肪酶了解胰腺炎病情变化

正确答案：C。CT检查注意是否发生胰腺坏死

解析：急性胰腺炎患者，抗生素治疗一周后症状加重，需考虑胰腺坏死继发感染。增强CT扫描不仅能诊断胰腺炎，而且能鉴别是否合并胰腺组织坏死，还可在网膜囊内、胰周、结肠后甚至髂窝等处发现胰外积液和坏死感染征象。因此，此时应紧急选择最有诊断意义的检查是CT检查注意是否发生胰腺坏死（C对）。炎症反应时，血白细胞计数+分类（A错）一般都升高，缺乏诊断特异性。患者诊断优先考虑胰腺坏死继发感染而非肠麻痹（B错），因此腹部平片的诊断意义不大。腹腔穿刺检测渗出液淀粉酶含量（D错）及检查血脂肪酶（E错）可用于诊断胰腺炎，但二者均无法判断胰腺病变程度及有无并发症。